不宜采用修复体修复方法治疗牙体缺损的牙是
A. 上颌恒切牙
B. 下颌恒切牙
C. 恒双尖牙
D. 恒磨牙
E. 乳牙

正确答案：E。乳牙

解析：本题考查修复体修复。不宜采用修复体修复方法治疗牙体缺损的牙是乳牙（E错，为本题的正确答案）。用修复体修复乳牙，影响乳恒牙的交替，使乳牙不能正常脱落，不能正常引导恒牙的萌出，导致恒牙的异位萌出。恒牙（ABCD对）可以采用修复体修复方法治疗牙体缺损，以恢复牙齿的外形及功能。